属于抗孕激素药，用于终止早孕的是
A. 米非司酮
B. 甲地孕酮
C. 左炔孕酮
D. 黄体酮
E. 地屈孕酮

正确答案：A。米非司酮

解析：本题考查抗孕激素药。米非司酮（A对）与孕酮竞争孕激素受体，达到拮抗孕酮的作用，具有终止早孕、抗着床、诱导月经及促进宫颈成熟等作用。